男，60岁。上腹部饱胀不适1年，无反酸，嗳气，呕吐。无腹痛、腹泻，查体：T36.5℃，P80次/分，R18次/分，BP120/80mmHg。双肺呼吸音清，未闻及干湿性啰音，心律齐，腹软，无压痛。胃镜检查示：胃体部黏膜灰白色，血管透见。胃黏膜活组织病理检查：胃体腺体明显减少。为进一步明确诊断，应进行的实验室检查是
A. 血胃泌素
B. 血抗线粒体抗体
C. 血抗壁细胞抗体
D. 血抗核抗体
E. 血胃蛋白酶原Ⅰ/Ⅱ比例

正确答案：C。血抗壁细胞抗体

解析：患者上腹部饱胀不适，胃镜检查示：胃体部黏膜灰白色，血管透见。胃体腺体明显减少。因此最可能的诊断是慢性萎缩性胃炎。为进一步明确诊断，应进行的实验室检查是血抗壁细胞抗体（C对）。当体内出现针对壁细胞或内因子的自身抗体时（病因），自身免疫性的炎症反应导致壁细胞总数减少、胃体腺体萎缩、胃体部黏膜灰白色，血管透见，导致慢性萎缩性胃炎（结果）。